可摘局部义齿大连接体的种类包括
A. 舌板
B. 腭板
C. 舌杆
D. 腭杆
E. 以上说法均正确

正确答案：E。以上说法均正确

解析：大连接体的种类：①腭杆；②腭板；③舌杆；④舌板。掌握“局部义齿连接体”知识点。